医师在执业活动中应当履行法定义务。不属于法定义务的是
A. 遵守技术操作规范
B. 参与所在机构的民主管理
C. 遵守职业道德
D. 尊重患者，保护患者的隐私
E. 宣传卫生保健知识

正确答案：B。参与所在机构的民主管理

解析：医师在执业活动中的义务　医师在执业活动中履行下列义务：①遵守法律、法规，遵守技术操作规范；②树立敬业精神，遵守职业道德，履行医师职责，尽职尽责为患者服务；③关心、爱护、尊重患者，保护患者的隐私；④努力钻研业务，更新知识，提高专业技术水平；⑤宣传卫生保健知识，对患者进行健康教育。掌握“医师执业规则及培训、考核及法律责任”知识点。